龋病导致的牙体硬组织缺损，可由以下哪种方法治疗
A. 药物治疗
B. 自行修复
C. 充填治疗
D. 再矿化疗法
E. 以上方法均可以

正确答案：C。充填治疗

解析：本题考查龋病导致的牙体硬组织缺损的治疗。龋病导致的牙体硬组织缺损，需采用充填治疗的方法（C对）。药物治疗（A错）和再矿化治疗（D错），适用于未出现牙体组织缺损的早期釉质龋损。釉质内无细胞和体液循环，没有自行修复的能力（B错）。